男，60岁，腮腺区无痛性包块2年，近3个月来肿物区有疼痛和麻木感，包块质硬，与周围组织粘连，不活动。镜下可见肿瘤组织内可见腺管样上皮、软骨样组织和黏液样组织，其中上皮细胞成分丰富，核多形性，瘤体组织侵犯包膜。病理诊断为
A. 多形性腺瘤
B. 恶性多形性腺瘤
C. 腺样囊性癌
D. 腺泡细胞癌
E. 以上均不是

正确答案：B。恶性多形性腺瘤

解析：本题考查恶性多形性腺瘤的临床病理表现。男，60岁，腮腺区无痛性包块2年（临床表现和发病部位符合多形性腺瘤），近3个月来肿物区有疼痛和麻木感，包块质硬，与周围组织粘连，不活动（恶变）。镜下可见肿瘤组织内可见腺管样上皮、软骨样组织和黏液样组织（符合多形性腺瘤的临床病理表现），其中上皮细胞成分丰富，核多形性，瘤体组织侵犯包膜（恶性）。综合考虑为恶性多形性腺瘤（B对）。恶性多形性腺瘤一般可分为三种类型：多形性腺瘤癌变、癌肉瘤和转移性多形性腺瘤。多发生于腮腺，男性多于女性，通常发生于50～70岁。典型的临床表现是长期存在的肿块生长突然加快，如果浸润神经和周围组织，可伴有疼痛、面瘫、固定和溃疡形成。癌变部分通常界限不清，并且有广泛浸润，光镜下可表现为多形性腺瘤组织学结构中有数量不等的恶性成分。多形性腺瘤（A错）一般生长缓慢，无自觉症状，也没有恶性成分，与题目中的临床病理表现不吻合，它是一种具有多种细胞形态和结构特征的良性肿瘤，临床表现为生长缓慢的肿块，可活动，包膜不完整。光镜下基本结构有腺上皮、肌上皮、黏液、黏液样组织和软骨样组织。病期在5～10年以上，直径超过4cｍ的多形性腺瘤胥观察是否存在局灶性恶变和包膜外浸润。腺样囊性癌（C错）是一种基底细胞样肿瘤，它由上皮细胞和肌上皮细胞排列成管状、筛状和实性巢等不同的形态结构，与题目中的临床病理表现不吻合，它可发生于任何年龄，但以40～60岁多见，发生部位以腮腺和腭腺居多。肉眼观察无包膜，呈浸润性生长，光镜下，肿瘤实质细胞主要为导管内衬上皮细胞和变异肌上皮细胞。这两种细胞排列成管状、筛状和实性结构。腺泡细胞癌（D错）是唾液腺恶性上皮肿瘤，它为低度恶性肿瘤，女性稍多，多发生于腮腺，多数肿瘤生长缓慢，实质性，活动，少数肿瘤生长较快，与皮肤和肌组织粘连而不活动。肿瘤实质细胞有腺泡样细胞、闰管样细胞、空泡样细胞、透明细胞和非特异性腺样细胞。常排列成实性型，微囊型，滤泡型，乳头囊状型，与题目中的临床病理表现不吻合。